既活血止痛，又消肿生肌的药是
A. 乳香
B. 苏木
C. 姜黄
D. 干漆
E. 王不留行

正确答案：A。乳香